乳腺癌侵及Cooper韧带，可导致
A. 皮肤凹陷
B. 橘皮样变
C. 卫星结节
D. 铠甲状癌
E. Paget病

正确答案：A。皮肤凹陷

解析：胸壁浅筋膜发出许多小的纤维束，向深面连于胸筋膜，在浅面连于皮肤，对乳房起支持和固定作用，称为乳房悬韧带或Cooper韧带。乳腺癌侵及Cooper韧带可使其缩短，牵引皮肤凹陷（A对）。橘皮样变（B错）由皮下淋巴管被癌细胞堵塞，淋巴回流障碍，出现真皮水肿所致。卫星结节（C错）由癌细胞沿皮下淋巴管网广泛播散到乳房及其周围皮肤并形成小结节所致。乳腺癌广泛浸润皮肤，融合成暗红色，弥漫成片，甚至可蔓延到背部及对侧胸部皮肤，形成盔甲样，称为铠甲状癌（D错）。Paget病（E错）即乳头湿疹样乳腺癌，少见，恶性程度低，发展慢。